下列各中成药中，联合用药合理的是
A. 更衣丸与消嘤丸
B. 蛇胆川贝液与人参再造丸
C. 金匮肾气丸与牛黄解毒片
D. 心痛口服液与通宣理肺丸
E. 血府逐瘀口服液与七厘散

正确答案：E。血府逐瘀口服液与七厘散

解析：本题考查的是合理用药。下列各中成药中，联合用药合理的是血府逐瘀口服液与七厘散（E对）。含朱砂较多的中成药，如磁朱丸、更衣丸（A错）、安宫牛黄丸等与含较多还原性溴离子或碘离子的中成药如消瘿五海丸、内消瘰疬丸等长期同服，在肠内会形成有刺激性的溴化汞或碘化汞，导致药源性肠炎、赤痢样大便。治疗风寒湿痹证的大活络丸、尪痹冲剂、天麻丸、人参再造丸（B错）等均含有附子，而止咳化痰的川贝枇杷露、蛇胆川贝液、通宣理肺丸等分别含有川贝、半夏，依据配伍禁忌原则，若将上述两组合用，附子、乌头与川贝、半夏当属相反禁忌同用之列。附子理中丸与黄连上清丸、金匮肾气丸与牛黄解毒片（C错）等合用，均属不注意证候的不合理用药。临床常用中成药心通口服液（D错）、内消瘰疬丸中含有海藻，祛痰止咳颗粒含有甘遂，若与橘红痰咳颗粒、通宣理肺丸、镇咳宁胶囊等含甘草的中成药联用也属禁忌之列。